属于神经氨酸酶抑制剂的抗流感病毒药物
A. 阿比多尔
B. 奥司他韦
C. 博洛昔韦
D. 法匹拉韦
E. 利巴韦林

正确答案：B。奥司他韦

解析：本题考查抗流感病毒药物的分类。抗流感病毒药物的分类：①神经氨酸酶抑制剂：奥司他韦（B对）、扎那米韦、帕拉米韦、拉尼米韦；②非糖基化基质蛋白抑制剂：金刚乙胺、金刚烷胺；③RNA聚合酶抑制剂：法匹拉韦（D错）、博洛昔韦（C错）；④细胞血凝素抑制剂:阿比多尔（A错）。利巴韦林（E错）为治疗慢性丙肝药。